一般排卵发生在月经来潮前
A. 7天左右
B. 14天左右
C. 16天左右
D. 18天左右
E. 22天左右

正确答案：B。14天左右

解析：本题考查排卵的日期。一般排卵发生在月经来潮前14天左右（B对）。